影响气道阻力的最主要因素是
A. 气道内径
B. 气道长度
C. 气道形态
D. 气流速度
E. 气流形式

正确答案：A。气道内径

解析：影响气道阻力的因索有：气道内径、长度和形态、气流速度和形式等，其中最主要的是气道内径（A对）。